新生儿，出生5天后皮肤黄染，一般情况好，吃奶好，胆红素是214μmol/L，考虑诊断为
A. 生理性黄疸
B. 溶血性黄疸
C. 母乳性黄疸
D. 新生儿肝炎
E. 新生儿败血症

正确答案：A。生理性黄疸

解析：生理性黄疸也称为非病理性高胆红素血症，在我国几乎所有足月新生儿在生后早期都会出现不同程度的暂时性血清胆红素增高。生理性黄疸是排除性诊断，其特点为；①一般情况良好；②足月儿生后2~3天出现黄疸，4~5天达高峰，5~7天消退，最迟不超过2周；早产儿黄疸多于生后3~5天出现，5~7天达高峰，7~9天消退，最长可延迟到3-4周；③每日血清胆红素升高<85umol/L（5mg/dl）或每小时<0.5mg/dl；④血清总胆红素值尚未超过小时胆红素曲线（Bhutani曲线）的第95百分位数，或未达到相应日龄、胎龄及相应危险因素下的光疗干预标准，由图6-11可知，胆红素为214μmol/L（＜342μmol/L）的日龄5天健康新生儿未达到光疗干预标准，故意答案选择为生理性黄疸（A对）。